注册主管部门应当自收到变更注册申请之日起（）内办理变更注册手续
A. 7天
B. 14天
C. 30天
D. 60天
E. 半年

正确答案：C。30天

解析：注册主管部门应当自收到变更注册申请之日起30日内办理变更注册手续。对因不符合变更注册条件不予变更的，应当自收到变更注册申请之日起30日内书面通知申请人，并说明理由。申请人如有异议的，可以依法申请行政复议或者向人民法院提起诉讼。掌握“执医概述及考试和注册”知识点。